患者恶寒发热，无汗，头痛，身痛，喘咳，舌苔薄白，脉浮紧。其证候是
A. 湿淫
B. 暑淫
C. 寒淫
D. 风淫
E. 燥淫

正确答案：C。寒淫

解析：根据患者临床表现，可以得出患者所患为表寒证，属于寒淫证的范畴。寒为阴邪，其性清冷，遏制并损伤阳气，寒性凝滞、收引，阻碍气血运行，郁闭肌肤，阳气失却温煦，故出现恶寒、头身疼痛、无汗、脉浮紧等症状（C对）。湿淫证的辨证依据是，起病较缓而缠绵，以困重、酸楚、痞闷、腻浊等为证候特点（A错）。暑淫证的辨证依据是，夏月有感受暑热之邪的病史，发热、口渴、汗出、疲乏、尿黄等为常见症状（B错）。风淫证的辨证依据是，可表现为新起恶风、微热、汗出、脉浮缓等症状（D错）。燥淫证的辨证依据是，常见于秋季或处气候干燥的环境，具有干燥不润的证候特点。而而患者有恶寒发热，无汗，脉浮紧等表寒症状，故患者症状与燥淫证临床表现不符（E错）。